职业性有害因素对妇女产生的生殖损伤包括
A. 性功能障碍和月经改变
B. 异常妊娠结局和不孕
C. 流产、早产、死胎、妊娠并发症
D. 生殖功能障碍和不良生殖结局
E. 以上都是

正确答案：E。以上都是

解析：本题考查职业性有害因素对妇女的生殖损伤。毒物对生殖系统的毒作用包括对接触者本人的生殖及其对子代发育过程的不良影响，即生殖毒性和发育毒性。生殖毒性包括对接触者生殖器官、相关内分泌系统、性周期和性行为、生育力、妊娠结局、分娩过程等方面的影响（E对ABCD错）；发育毒性可表现为胎儿结构异常、发育迟缓、出生体重不足、功能缺陷、甚至死亡等。很多生产性毒物具有一定的生殖毒性和发育毒性。